带下病的主要发病机制是
A. 外感湿邪，损及任、带，约固无力
B. 肾气不足，封藏失职，阴液滑脱而下
C. 湿邪影响任、带，任脉不固，带脉失约
D. 脾虚生湿，流注下焦，伤及任、带
E. 肝经湿热，流注下焦，伤及任、带

正确答案：C。湿邪影响任、带，任脉不固，带脉失约

解析：带下病包括带下过多，带下过少。带下过多的主要病因是湿邪，为湿邪伤及任带二脉，致任脉不固，带脉失约所致。带下过少为阴液不足，不能渗润阴道所致，病因多为肝肾亏损、血枯瘀阻。外感湿邪为带下病的病因之一，非主要发病机制（A错）。肾气不足，封藏失职不导致带下病（B错）。湿邪影响任、带，任脉不固，带脉失约可致带下过多，是带下过多总的发病机制，为带下病的主要发病机制（C对）。脾虚生湿，流注下焦，伤及任、带可导致带下过多，为其病因之一（D错）。肝经湿热，流注下焦，伤及任、带可致带下过多，为其病因之一（E错）。